关于急性毒性试验中动物选择的原则说法错误的是
A. 一般要求选择两个不同种属
B. 通常选择刚断乳动物
C. 雌雄各半
D. 常用哺乳类动物
E. 每组实验动物的数量因求LD₅₀方法不同而不同

正确答案：B。通常选择刚断乳动物